饮水使用臭氧消毒时，会产生的致癌物是
A. 氯仿
B. 溴乙酸
C. 二溴一氯甲烷
D. 二溴乙酸
E. 溴酸盐

正确答案：B。溴乙酸

解析：本题考查饮水的臭氧消毒。臭氧消毒是一种常用的水处理技术，它可以有效地杀灭水中的细菌、病毒和其他有害微生物，从而提高水的卫生质量。臭氧消毒过程中，会产生一些有害物质，其中最常见的是溴乙酸（B对ACDE错），它是一种致癌物质，可以通过水体进入人体，对人体健康造成危害。